以下能影响人群疾病的患病率的因素是
A. 疾病治愈率的改变
B. 疾病发生率的改变
C. 疾病病例定义的改变
D. A＋B＋C
E. A＋B

正确答案：D。A＋B＋C

解析：本题考查影响人群疾病的患病率的因素。患病率是指某特定时间内总人口中某病新旧病例所占的比例。能影响人群疾病的患病率的因素有：疾病治愈率的改变、疾病发生率的改变、疾病病例定义的改变（D对ABCE错）。